我国孕妇和哺乳期妇女每人每天碘摄入量推荐值为
A. 250μg
B. 200μg
C. 150μg
D. 100μg
E. 65μg

正确答案：A。250μg

解析：本题考查我国孕妇和哺乳期妇女每人每天碘摄入量推荐值。根据代谢测定，碘的生理需要量成人为100～300μg/d，我国推荐每日碘供给量150μg。妊娠与哺乳妇女及青少年的需要量较一般人为高，推荐孕妇和哺乳期妇女每人每天碘摄入量为250μg（A对BCDE错）。